医学科学研究的作用也有双向性，表现在
A. 防病与治病
B. 基础医学与临床医学
C. 造福人类与危害人类
D. 社会医学与医学社会学
E. 医学科学与医学道德

正确答案：C。造福人类与危害人类